在病因学上，三角模型与轮状模型相比，主要的不同点是
A. 强调病因、宿主、环境三者的动态平衡
B. 更强调环境的作用
C. 更强调遗传因子的作用
D. 强调病因为独立的成分
E. 强调疾病是多因素综合作用的结果

正确答案：A。强调病因、宿主、环境三者的动态平衡